主治医师为一名择期手术患者提交了临床用血申请，经上级医师核准后予以签发，依照《医疗机构临床用血管理办法》的规定，申请的备血量应是
A. 1000毫升
B. 1200毫升
C. 1600毫升
D. 600毫升
E. 900毫升

正确答案：D。600毫升

解析：主治医师（具有中级以上专业技术职务任职资格的医师）为一名择期手术患者提交了临床用血申请，依照《医疗机构临床用血管理办法》的规定，同一患者一天申请的备血量应少于800毫升，600毫升（D对）符合，经上级医师核准后予以签发，方可备血；同一患者一天申请备血在800毫升至1600毫升（ABE错）的，由具有中级以上专业技术职务任职资格的医师提出申请，经上级医师审核，科室主任核准签发后，方可备血；同一患者一天申请备血量达到或超过1600毫升（C错）的，由具有中级以上专业技术职务任职资格的医师提出申请，科室主任核准签发后，报医务部门批准，方可备血。